治疗有机磷农药中毒毒蕈碱样症状的药物是
A. 阿托品
B. 氯解磷定
C. 利多卡因
D. 甲硝唑（灭滴灵）
E. 双复磷

正确答案：A。阿托品

解析：阿托品（A对）主要作用于外周M受体，能缓解毒蕈样症状（M样症状）。氯解磷定（B错）可复活有机磷杀虫剂抑制的胆碱酯酶活力，利多卡因（C错）可缓解心律失常，甲硝唑（灭滴灵）（D错）用于杀灭真菌、滴虫等，双复磷（E错）可消除中枢神经系统症状，以上均不是治疗有机磷农药中毒毒蕈碱样症状的药物。